关于蛋白质合成的错误叙述是
A. 20种氨基酸都有相应的密码
B. 氨基酸以氨基与tRNA共价相连
C. 氨基酸与tRNA3’-端连接
D. 核糖体是蛋白质翻译的场所
E. mRNA是多肽合成的直接模板

正确答案：B。氨基酸以氨基与tRNA共价相连

解析：mRNA中的密码20种氨基酸都有相应的密码子（A对），每种氨基酸都至少有一个相应的密码子。氨基酸与tRNA端连接（C对），即氨基酸以羧基与tRNA的3＇-端羟基以酯键共价相连（B错，为本题正确答案），生成的氨基酰-tRNA，以mRNA为直接模板（E对），在核糖体中（D对），参与肽链和蛋白质的合成。